《本草经集注》在各论首创按药物自然属性分类法，将所载的730种药物分为玉石、草木、虫兽、果、菜、米食及有名未用7类。该书作者及成书年代是
A. 唐慎微，宋代
B. 李时珍，明代
C. 张仲景，汉代
D. 陶弘景，魏晋南北朝
E. 赵学敏，清代

正确答案：D。陶弘景，魏晋南北朝

解析：本题考查《本草经集注》的作者和成书年代。《本草经集注》为魏晋南北朝本草代表作，陶弘景（D对）著。该书首创按药物自然属性分类法，初步确立了综合性本草著作的编写模式。《经史证类备急本草》简称《证类本草》，为宋金元时期宋代的本草代表作，作者唐慎微（A错）。《本草纲目》简称《纲目》，为明代本草代表作。该书的作者为伟大医药学家李时珍（B错），他采用多学科综合研究的方法，以毕生精力对本草学进行了全面深入的研究整理。《本草纲目拾遗》简称《纲目拾遗》，为清代本草代表作。作者赵学敏（E错）在广泛收集民间用药和注意研究外来药的基础上撰成此书。